男，56岁。患者突发右上腹痛1天，曾有胆囊泥沙样结石，现影像学肝内外胆管未见明显异常，胆囊肿大明显，最可能的梗阻部位是
A. 肝左管
B. 肝右管
C. 胆囊管
D. 胆总管
E. 肝总管

正确答案：C。胆囊管

解析：结石嵌顿在胆囊壶腹部或颈部，胆囊排空受阻，胆囊内压力升高，胆囊强力收缩而发生绞痛，疼痛位于右上腹或上腹部，呈阵发性，或持续疼痛阵发性加剧（C对）。肝外胆管结石可出现典型的Charcot三联征：腹痛 寒战高热和黄疸。发生在剑突下或右上腹，多为绞痛，呈阵发性发作，或为持续性疼痛阵发性加剧，可向右肩或背部放射，常伴恶心、呕吐 这是结石下移嵌顿于胆总管下端或壶腹部。